对代谢性酸中毒H+的缓冲主要依靠
A. 磷酸盐缓冲系统
B. 血浆蛋白缓冲系统
C. 血红蛋白缓冲系统
D. 碳酸氢盐缓冲系统
E. 氧合血红蛋白缓冲系统

正确答案：D。碳酸氢盐缓冲系统

解析：缓冲固定酸的主要缓冲对是碳酸氢盐缓冲系统,所以对代谢性酸中毒H+的缓冲主要依靠碳酸氢盐缓冲系统（D对）。